阴阳的相互转化是
A. 绝对的
B. 有条件的
C. 必然的
D. 偶然的
E. 量变

正确答案：B。有条件的

解析：阴阳转化是阴阳运动的又一种基本形式，在阴阳双方的消长运动发展到一定的阶段，其消长变化达到一定的阈值，就可能导致阴阳属性的转化。在事物的发展过程中，如果把阴阳的消长变化看作一个量变的过程，阴阳转化则表现为量变基础上的质变，所以说阴阳转化不是绝对的（A错），也非必然（C错）或偶然的（D错），而是消长变化达到了“极”程度的条件下发生的，是有条件的（B对），是一种质变（E错）。